右心房的内腔
A. 右心耳壁较光滑
B. 上腔静脉口有发达的瓣膜环
C. 前部光滑、后部成网状
D. 腔静脉窦与心耳以界嵴分隔
E. 有心前静脉的直接开口处

正确答案：E。有心前静脉的直接开口处

解析：右心房右心耳壁肌束交错成网较为凹凸不平（A错）。下腔静脉口（B错）有发达的瓣膜环。右心房的内腔前部成网状、后部光滑（C错）。腔静脉窦与固有心房（D错）以界嵴分隔。右心房的内腔有心前静脉的直接开口处（E对）。